属于溶液型液体药剂的是
A. 薄荷水
B. 炉甘石洗剂
C. 胃蛋白酶溶液
D. 右旋糖酐注射液
E. 松节油搽剂

正确答案：A。薄荷水